心舒张时，防止血液逆行流动的装置
A. 主动脉瓣、三尖瓣
B. 二尖瓣、三尖瓣
C. 主动脉瓣、肺动脉瓣
D. 肺动脉瓣、三尖瓣
E. 主动脉瓣、二尖瓣

正确答案：C。主动脉瓣、肺动脉瓣

解析：主动脉瓣、肺动脉瓣（C对）均为心舒张时，防止血液逆行流动的装置，当心室舒张时，主动脉瓣和肺动脉瓣相互靠拢闭合，可以阻止血液反流。